医学模式的转变，医患关系应特别注重哪种水平上的交往
A. 技术水平
B. 非技术水平
C. 言语水平
D. 非言语水平
E. 以上都是

正确答案：B。非技术水平